宜在饭后服的药物是
A. 驱虫药
B. 泻下药
C. 滋补药
D. 安神药
E. 健胃药

正确答案：E。健胃药

解析：病在胸膈以上者如眩晕、头痛、目疾、咽痛等宜饭后服，某些对肠胃有刺激的药物宜饭后服（E对）。补益药多滋腻碍胃，宜空腹服，驱虫药、泻下药也宜空腹服（ABC错）。安神药宜睡前服（D错）。